男，45岁。诊断为轻度高血压，首次服用抗高血压药物后出现直立性低血压，并有晕厥、心悸等症状，该患者最有可能服用的药物是
A. 可乐定
B. 哌唑嗪
C. 硝苯地平
D. 普萘洛尔
E. 卡托普利

正确答案：B。哌唑嗪